女，35岁。腹胀、腹部隐痛伴低热3个月。突发脐周绞痛6小时，呕吐数次，无排气，排便。首选的检查是
A. 结肠镜检查
B. 立位腹部X线平片
C. 腹部B超
D. 腹部CT
E. 腹部MRI

正确答案：B。立位腹部X线平片

解析：青年女性患者，腹痛、腹胀伴低热3个月，突发脐周绞痛、呕吐，无排便、排气（提示急性肠梗阻），最可能的诊断为结核性腹膜炎并肠梗阻。腹部X线平片可显示肠系膜淋巴结钙化影，有助于结核性腹膜炎的诊断；肠梗阻在腹部平片上可见阶梯状的液气平面，因此，该患者的首选检查是立位腹部X线平片（B对）。结肠镜检查（A错）主要用于肠道内病变的诊断，肠梗阻时一般不用。腹部B超（C错）多用于肝、脾等实质性脏器的检查，对胃肠道等空腔器官的显示效果不佳。腹部CT（D错）与MRI（E错）可详尽显示腹腔内病变情况，但其耗时长，价格较贵，不做为首选检查。